患儿男，4岁。症见面赤身热、咳嗽气促、痰多黏稠、咽痛声哑。证属风寒外束、肺经痰热。治当清肺、解表、化痰、止嗽，宜选用的中成药是
A. 儿童清肺丸
B. 小儿咳喘灵颗粒
C. 小儿消积止咳口服液
D. 鹭鸶咯丸
E. 清宣止咳颗粒

正确答案：A。儿童清肺丸

解析：本题考查儿童清肺丸的功能。治当清肺、解表、化痰、止嗽，宜选用的中成药是儿童清肺丸（A对）。儿童清肺丸（合剂）【功能】清肺，解表，化痰，止嗽。小儿咳喘灵颗粒（B错）【功能】宣肺清热，止咳祛痰，平喘。小儿消积止咳口服液（C错）【功能】清热肃肺，消积止咳。鹭鸶咯丸（D错）【功能】宣肺，化痰，止咳。清宣止咳颗粒（E错）【功能】疏风清热，宣肺止咳。